红灵散与庆大霉素同用，能
A. 形成络合物沉淀
B. 引发肝脏损害
C. 产生永久性结合物
D. 引发永久性耳聋
E. 引发药源性肠炎

正确答案：D。引发永久性耳聋

解析：本题考查的是中西药联用。红灵散与庆大霉素同用，能引发永久性耳聋（D对）。碱性中药如硼砂、红灵散、女金丹等，能使氨基糖苷类抗生素如链霉素、庆大霉素、卡那霉素、阿米卡星等排泄减少，吸收增加，同时增加脑组织中的药物浓度，使耳毒性增加，造成暂时性或永久性耳聋。含钙、镁、铁等金属离子的中药，如石膏、瓦楞子、牡蛎、龙骨、海螵蛸、石决明、赭石、明矾等及其中成药，不能与四环素类抗生素联用，因金属离子可与此类西药形成络合物（A错），而不易被胃肠道吸收，降低疗效。含汞类中药及其制剂，如朱砂、轻粉、朱砂安神丸、仁丹、紫雪散、补心丹、磁朱丸等，不能与溴化钾、三溴合剂、碘化钾、碘喉片等同服，因汞离子与溴离子或碘离子在肠中相遇后，会生成有剧毒的溴化汞或碘化汞，从而导致药源性肠炎（E错）或赤痢样大便。